患者，女，31岁，自述乏力、纳差、月经量增多，查体发现其“匙状甲”、毛发干枯，诊断为缺铁性贫血。给予硫酸亚铁治疗，推荐的用法用量是
A. 0.3g tid
B. 20mg tid
C. 0.5g qd
D. 0.4mg qd
E. 5mg tid

正确答案：A。0.3g tid

解析：本题考查硫酸亚铁的用法用量。给予硫酸亚铁治疗，推荐的用法用量是0.3g tid（A对）。硫酸亚铁为铁剂，用于防治各种原因（如慢性失血、营养不良、妊娠、儿童发育期等）引起的缺铁性贫血。硫酸亚铁用法用量：预防量为0.3g qd；治疗量为0.3g tid；儿童50～100mg tid。